正常胎儿成熟度的判定，正确的是
A. 羊水肌酐值≥88.4umol/L（1mg%）提示胎儿肾成熟
B. 羊水胆红素类物质△OD450＜0.10，提示胎儿肝成熟
C. 羊水卵磷脂/鞘磷脂比值＞1，提示胎儿肺成熟
D. 羊水含脂肪细胞出现率＞10%，提示胎儿皮肤成熟
E. B超测胎儿双顶径＞8.5cm，提示胎儿成熟

正确答案：E。B超测胎儿双顶径＞8.5cm，提示胎儿成熟

解析：羊水肌酐＞176.8umol/L，提示胎儿肾成熟（实用妇产科学第2版P114）（A错）；羊水胆红素类物质接近于0，提示胎儿肝成熟（B错）；羊水卵磷脂/鞘磷脂比值＞2，提示胎儿肺成熟（C错）；羊水含脂肪细胞出现率＞10%～20%，提示胎儿皮肤成熟（实用妇产科学第2版P114）（D错）；B超测胎儿双顶径（BPD）＞8.5cm，提示胎儿成熟（E对）。